有关酶竞争性抑制剂特点的叙述，错误的是
A. 抑制剂与底物结构相似
B. 抑制剂与底物竞争酶分子中的底物结合
C. 当抑制剂存在时，Km值变大
D. 抑制剂恒定时，增加底物浓度，能达到最大反应速度
E. 抑制剂与酶分子共价结合

正确答案：E。抑制剂与酶分子共价结合